常用的非生物降解型植入剂材料是
A. 聚乳酸
B. 硅橡胶
C. 卡波姆
D. 明胶-阿拉伯胶
E. 醋酸纤维素

正确答案：B。硅橡胶

解析：本题考查药物微囊化的材料。硅橡胶（B对）是生物相容性、无毒、释放速率理想的生物不降解型植入剂材料。聚乳酸（A错）为生物可降解型材料。卡波姆（C错）为亲水凝胶骨架材料。明胶-阿拉伯胶（D错）属于天然高分子囊材。醋酸纤维素（E错）酞酸酯为肠溶性高分子材料。